胺碘酮延长心肌动作电位时程是主要由于
A. Na⁺外流减少
B. Ca²⁺外流减少
C. K⁺外流减少
D. Mg²⁺ 外流减少
E. Cu²⁺ 外流减少

正确答案：C。K⁺外流减少